上述各项，属于继发感染的是
A. 初次感染某种病原体
B. 在感染某种病原体基础上再次感染同一种病原体
C. 人体同时感染两种或两种以上的病
D. 在感染某种病原体基础上又被其他病原体感染
E. 原发感染后出现其他病原体感染

正确答案：E。原发感染后出现其他病原体感染

解析：在重叠感染中，发生于原发感染后的其他病原体感染称为继发性感染（E对）。人体初次被某种病原体感染称为首发感染（A错）。重复感染是指人体在被某种病原体感染的基础上再次被同一种病原体感染（B错）。人体同时被两种或两种以上的病原体感染称为混合感染（C错）。人体在某种病原体感染的基础上再被另外的病原体感染称为重叠感染（D错）。